男，33岁。急性坏疽性阑尾炎手术后4天，出现尿频、尿急、大便次数增多、里急后重、发热。其最可能的并发症是
A. 急性肾盂肾炎
B. 盆腔脓肿
C. 肛周脓肿
D. 阑尾残株炎
E. 急性膀胱炎

正确答案：B。盆腔脓肿

解析：青年男性患者，急性坏疽性阑尾炎手术后出现发热（提示继发感染的可能），尿频、尿急（膀胱刺激症状），大便次数增多、里急后重（直肠刺激症状），该患者最可能的并发症是盆腔脓肿（B对）。阑尾炎术后患者处于半卧位时，盆腔处于腹腔的最低位，阑尾炎坏疽后形成的炎性渗出物或脓液易积聚于此形成盆腔脓肿，临床可表现为发热、直肠或膀胱刺激症状（如里急后重、便频、黏液便、尿频、尿急）。急性肾盂肾炎（A错）主要表现为突发的寒战、高热、腰部疼痛和膀胱刺激症状，无直肠刺激症状。肛周脓肿（C错）一般为局限性的感染灶，表现为肛周持续性跳动性疼痛，而全身感染症状表现不明显。阑尾残株炎（D错）为阑尾术后残株炎症复发，临床表现同阑尾炎，主要为右下腹麦氏点压痛、反跳痛。急性膀胱炎（E错）主要表现为膀胱刺激症状，发热等全身症状不明显，无直肠刺激症状。